全部由肠系膜上动脉分支供应的器官是
A. 降结肠
B. 乙状结肠
C. 直肠
D. 横结肠
E. 肛管

正确答案：D。横结肠

解析：横结肠（D对）为全部由肠系膜上动脉的分支中结肠动脉供应的器官。